决定蛋壳颜色的因素是
A. 蛋壳中钙含量
B. 蛋的重量
C. 禽的年龄
D. 禽的健康状况
E. 蛋壳中原卟啉色素

正确答案：E。蛋壳中原卟啉色素

解析：本题考查决定蛋壳颜色的因素。蛋壳的颜色从白色到棕色，蛋壳的颜色由蛋壳中的原卟啉色素（E对ABCD错）决定，该色素的合成能力因鸡蛋的品种而异，与蛋的营养价值关系不大。